患者，男，58岁。高血压病史20年，近1年常心慌，气短，昨夜睡眠中突然憋醒，胸痛，咳嗽，气喘，急诊入院。经检查诊断为急性肺水肿，左心衰竭。治疗应选用
A. 肾上腺素
B. 异丙肾上腺素
C. 山莨菪碱
D. 吗啡
E. 以上均非

正确答案：D。吗啡

解析：吗啡为阿片类生物碱药物，临床可用于心源性哮喘，缓解左心衰竭、肺水肿引起的呼吸困难、气促以及窒息感（D对），其主要机制为：1）吗啡具有镇静作用，可消除病人的紧张和恐惧情绪；2）吗啡可抑制呼吸中枢对二氧化碳的敏感性，使呼吸由浅快变得深慢；3）吗啡可扩张外周血管，降低外周阻力，减轻心脏前、后负荷，有利于肺水肿的消除。肾上腺素（A错）临床主要用于过敏性休克、心脏骤停、支气管哮喘等。异丙肾上腺素（B错）临床用于支气管哮喘、房室传导阻滞、心脏骤停等。山莨菪碱（C错）为阿托品类生物碱，临床可用于感染中毒性休克、内脏平滑肌绞痛、血管神经性头痛，眩晕症等。